某市教育委员会出台了《中小学校全面禁烟的规定》，属于健康促进学校六大内容的
A. 学校卫生政策
B. 学校物质环境
C. 学校社会环境
D. 个人健康技能
E. 卫生服务

正确答案：A。学校卫生政策